以下哪一项与沟纹舌、面神经麻痹组成梅-罗综合征
A. 血管神经性水肿
B. 药物过敏性口炎
C. 肉芽肿性唇炎
D. 舌乳头炎
E. 慢性唇炎

正确答案：C。肉芽肿性唇炎

解析：沟纹舌，同时出现肉芽肿性唇炎，面神经麻痹或有面神经麻痹史，则诊断为梅-罗综合征。掌握“地图舌、沟纹舌及舌乳头炎”知识点。